粒细胞缺乏症易引起感染，其粒细胞绝对计数低于多少时属拔牙禁忌证
A. 6×10⁹/L
B. 1×10⁹/L
C. 5×10⁹/L
D. 3×10⁹/L
E. 2×10⁹/L

正确答案：B。1×10⁹/L

解析：本题考查粒细胞缺乏症对牙拔除术的影响及拔牙禁忌证。若中性粒细胞如低于1×10⁹/L（B对）时，易引起严重的感染和影响创口愈合，属于拔牙禁忌症。粒细胞绝对计数低于2×10⁹/L（E错）称为粒细胞减少症，而不是粒细胞缺乏症；如低于1×10⁹/L，称为粒细胞缺乏症。如中性粒细胞在（2～2.5）×10⁹/L（E错），或白细胞总数在4×10⁹/L以上（ACD错），患者可耐受拔牙及手术。